1998年某乡流脑发病率为1.5/万，历年该乡该病年发病率为1.2～1.7/万，判断此流行形式
A. 流行
B. 大流行
C. 暴发
D. 散发

正确答案：D。散发

解析：本题考查散发的概念。散发（D对ABC错）指发病率呈历年的一般水平，各病例间在发病时间和地点上无明显联系，表现为散在发生。确定散发时多与当地近三年该病的发病率进行比较，如果当年发病率未明显超过既往平均水平称为散发。本题中的发病率符合散发的流行特征。